心理治疗道德要求中不正确的做法是
A. 运用心理学知识和技巧开导患者
B. 要有同情心和帮助患者的诚意
C. 患者有自伤或伤害他人行为时，应及时通知家属
D. 要以稳定的心理状态影响和帮助患者
E. 要为患者保守隐私和秘密

正确答案：C。患者有自伤或伤害他人行为时，应及时通知家属

解析：在心理治疗中，应遵循以下伦理要求：（一）保密1.保护患者隐私（E对），在心理治疗过程中，不可避免地会涉及患者的隐私，而且诊疗本身可能就是隐私的一部分。因此，保密在临床实践中显得尤为重要。患者向心理医生倾诉的信息，特别是秘密或隐私，不能泄露，甚至对患者的父母、配偶也要保密，否则会失去患者的信任，使心理治疗难以继续进行下去。但心理医生应清楚地了解保密要求的应用有其限度，在以下情况发生时保密会受限：患者有伤害自身或伤害他人的严重危险时、患者有致命的传染性疾病等且可能危及他人时、未成年人在受到性侵犯或虐待时、患者行为违反法律时等，在这些情况下，医务人员可以在患者事先知道的情况下，转告给其家人或他人（C错，为本题正确答案）。2.医学科研需要的隐私保护，对于心理诊疗过程中涉及的内容，例如心理咨询或治疗过程进行录音、录像或演示等，心理医生只有在得到患者的书面同意时，才能进行相应的处理或应用。3.青少年心理咨询的特殊要求，在青少年心理咨询中，除了需要向青少年来访患者解释保密的伦理要求外，也需要对其监护人进行解释和介绍，并对保密事宜作详尽清晰的说明，以确保各方对保密有同样的理解，有利于配合咨询和治疗过程的顺利开展。（二）尊重1.尊重患者的知情同意权。2.尊重患者的决定权。（三）科学1.运用心理治疗的知识和技巧开导患者（A对）。2.以专业的态度处理与咨询者或患者的关系。3.关注患者的同时更应关注自我保健，心理咨询和治疗是一种情绪劳动，个人内在环境很容易受到来访者的情绪感染和干扰，所以医务人员要以稳定的心理状态影响和帮助患者（D对）。（四）真诚1.对心理咨询和治疗本身的真诚。2.对患者真诚（B对）。